29岁孕妇，妊娠32周，3周内阴道少量流血2次，今凌晨突然阴道流血多于月经量，无腹痛，血压13.3/10.7kPa，脉率96次/分，宫高30cm，腹围85cm，臀先露，未入盆，胎心音清楚，144次/分下述何项处理是错误的
A. 住院观察
B. 绝对卧床休息
C. 配血备用
D. 口服镇静药片
E. 肛指检查

正确答案：E。肛指检查

解析：前置胎盘不宜进行肛诊。以免加重出血。掌握“前置胎盘”知识点。